声波的收集传导装置
A. 外耳
B. 外耳道
C. 鼓膜
D. 听小骨
E. 以上都是

正确答案：E。以上都是

解析：外耳（A对）和中耳是声波的收集和传导装置，而外耳包括耳郭、外耳道（B对）和鼓膜（C对）3部分。听小骨组成的听小骨链将声波的振动转换成机械能传入内耳（D对，故E为本题正确答案）。